可见匙状甲的疾病是
A. 肝硬化
B. 缺铁性贫血
C. 发绀型先天性心脏病
D. 支气管扩张
E. 吸收不良综合征

正确答案：B。缺铁性贫血

解析：匙状甲又称反甲，特点为指甲中央凹陷，边缘翘起，指甲变薄，表面粗糙有条纹，常见于缺铁性贫血（B对）和高原疾病，偶见于风湿热及甲癖。肝硬化（A错）、发绀型先天性心脏病（C错）、支气管扩张（D错）和吸收不良综合征（E错）均不见匙状甲。